紧张引起的心理反应可表现为
A. 血压升高、心率加快
B. 对工作不满意、感情淡漠、易怒
C. 过量吸烟、酗酒、频繁就医
D. 皮肤生物电反应增强
E. 脑诱发电位幅度和潜伏期改变

正确答案：B。对工作不满意、感情淡漠、易怒